指在疮疡的正邪交争中，正气能够约束邪气，使之不至于深陷或扩散所形成的局部肿胀范围是
A. 痈
B. 疽
C. 根盘
D. 根脚
E. 护场

正确答案：E。护场

解析：护场指在疮疡的正邪交争过程中，正气能够约束邪气，使之不至于深陷或扩散所形成的局部肿胀范围（E对）。痈：指气血被邪毒壅聚而发生的化脓性疾病。一般分为外痈和内痈两大类。外痈是指生于体表皮肉之间的化脓性疾患；内痈是指生于脏腑的化脓性疾患（A错）。疽：指气血被毒邪阻滞而发于皮肉筋骨的疾病。常见的有有头疽和无头疽两类。有头疽是发生在肌肤间的急性化脓性疾病，相当于西医的痈；无头疽是指多发于骨骼或关节间等深部组织的化脓性疾病，相当于西医的骨髓炎、骨结核、化脓性关节炎等（B错）。根盘：指肿疡基底部周围之坚硬区，边缘清楚（C错）。根脚：指肿疡之基底根部。一般多用于有头疽或疗的基底部的描述（D错）。